某患者，发热39℃，肝脾大，颈部淋巴结可触及，血液白细胞增多，异型淋巴细胞可检出。印象诊断是传染性单核细胞增多症，引起该病的病原体是
A. 腺病毒
B. 丙型肝炎病毒
C. 风疹病毒
D. 巨细胞病毒
E. EB病毒

正确答案：E。EB病毒